利福平属于
A. CYP3A4抑制剂
B. CYP3A4诱导剂
C. CYP2C19底物药物
D. CYP1A2底物药物
E. CYP2D6抑制剂

正确答案：B。CYP3A4诱导剂

解析：本题考查肝药酶抑制剂与诱导剂。CYP3A4诱导剂（B对）有利福平、巴比妥类、卡马西平、糖皮质激素、苯妥英钠等。CYP3A4抑制剂（A错）有红霉素、胺碘酮、西咪替丁、环丙沙星、克拉霉素、地尔硫䓬、多西环素等。CYP2C19底物药物（C错）有奥美拉唑、地西泮、美沙酮、奋乃静等。CYP1A2底物药物（D错）有茶碱、阿米替林、氯丙嗪、氯米帕明、氯氮平、度洛西汀、氟奋乃静等。CYP2D6抑制剂（E错）有胺碘酮、阿米替林、安非他酮、塞来昔布、氯苯那敏、氯丙嗪、西咪替丁等。